男，24岁。阵发性心悸3年，突发突止，每次持续0.5～3小时不等，无头晕和黑矇。发作时查体：BP120/70mmHg，心率180次/分，律齐。心电图示QRS波群形态和时限正常。该患者最可能的诊断是
A. 室性期前收缩
B. 阵发性室性心动过速
C. 窦性心动过速
D. 心房颤动
E. 阵发性室上性心动过速

正确答案：E。阵发性室上性心动过速

解析：患者青少年男性，阵发性心悸，发作呈现突然起始与终止（阵发性室上性心动过速最典型的特点），发作时心率180次/分（阵发性室上性心动过速心率常为150～250次/分），律齐，心电图示QRS波群形态和时限正常，故患者最可能的诊断为阵发性室上性心动过速（E对）。室性期前收缩（P196）（A错）心电图的特征有提前发生的QRS波，时限通常超过0.12秒、宽大畸形，ST段与T波的方向与QRS主波方向相反。阵发性室性心动过速（P198）（B错）可阵发性发作，心室率通常在100～250次/分，QRS波群形态畸形，多可见心室夺获与室性融合波。窦性心动过速（P182）（C错）通常逐渐开始和终止，频率大多在100～150次/分之间。心房颤动（P188）（D错）的常见心电图表现为P波消失，代之以频率约350～600次/分的f波。